患者，女，25岁，突然发热咳嗽流涕，2周后热退，出现胸闷，心率110次/min，气短，心电图示低电压，T波低平，左束支传导阻滞，室性期前收缩，应首先考虑
A. 急性心包炎
B. 扩张型心肌病
C. 病毒性心肌炎
D. 风湿性心肌炎
E. 风湿性心脏病

正确答案：C。病毒性心肌炎

解析：青年女性患者，突然发热咳嗽流涕（有上呼吸道感染病史），2周后热退出现胸闷，心率加快，气短（心脏受累表现），心电图示低电压，T波低平，左束支传导阻滞，室性期前收缩（典型的病毒性心肌炎心电图表现），结合患者临床表现及辅助检查，诊断首先考虑病毒性心肌炎（C对）。急性心包炎患者早期即有心包摩擦音，摩擦音和疼痛在心包腔出现渗液时均消失，有特征性胸痛（较剧烈而持久的心前区疼痛，其疼痛与发热同时出现，呼吸和咳嗽时加剧），心电图示广泛导联均有ST段弓背向下型抬高，T波倒置（A错）。扩张型心肌病患者临床可见心脏扩大、心率失常及心力衰竭，超声心动图可见全心扩大，以左心室扩大为主，无上呼吸道感染的前驱症状（B错）。风湿性心肌炎病前1-3周有链球菌感染史或感染的其他证据，常有心脏杂音，可有关节疼痛、环形红斑、皮下结节、舞蹈病，辅助检查示血沉增快、CRP阳性、心电图P-R间期延长等（C错）。风湿性心脏病是指由于风湿热活动，累及心脏瓣膜而造成的心脏瓣膜病变。表现为二尖瓣、三尖瓣、主动脉瓣中一个或几个瓣膜狭窄或或关闭不全，患病初期常常无明显症状，后期表现为心慌气短、乏力、咳嗽、下肢水肿、咳粉红色泡沫痰等心功能失代偿的表现（E错）。